乳牙列中龋病最好发的牙齿为
A. 下颌第二乳磨牙
B. 上颌第二乳磨牙
C. 乳下前牙
D. 下颌第一磨牙
E. 下前牙

正确答案：A。下颌第二乳磨牙

解析：乳牙列中下颌第二乳磨牙最易患龋。掌握“龋病的临床表现与分类”知识点。